肝火引起经行头痛的特点是
A. 头晕，头部绵绵作痛
B. 巅顶掣痛，头晕目眩
C. 头痛剧烈，痛如锥刺
D. 头部胀痛重着
E. 头痛如裹，头晕目眩

正确答案：B。巅顶掣痛，头晕目眩

解析：素体血虚，遇经行则血愈虚，血不上荣，故头晕，头部绵绵作痛，此为血虚经行头痛的特点（A错）。素体阳气偏亢，足厥阴肝经与督脉上会于巅，而冲脉附于肝，经行冲气偏旺，故肝火易随冲气上逆，风阳上扰清窍，而致经行巅顶掣痛，肝火内炽，则头晕目眩（B对）。头为诸阳之会，因瘀血内停，脉络不通，阻塞清窍，则每逢经行瘀血动，欲行不得，故头痛剧烈，痛有定处，此为经行瘀血头痛的特点（C错）。头部胀痛为气机阻滞清阳所致，气滞不畅，浊阴湿邪不降而致头部重着，故头部胀痛重着为气滞湿阻型的头痛（D错）。头痛如裹，头晕目眩为风湿之邪，上蒙头窍，困遏清阳所致，为风湿头痛的特点（E错）。